患有肝脏疾病的患者，在饮食调养方面，尤其应该.
A. 忌食脂肪
B. 忌食咸食
C. 戒酒
D. 忌食甜食
E. 戒烟

正确答案：C。戒酒

解析：肝病患者喝酒会进一步加重肝病的严重程度（C对）；对于肝病患者，要摄入充足蛋白质、维生素和适当的能量、脂肪、碳水化合物，禁止食入刺激性的食物，少吃咸食、甜食，少抽烟（ABDE错）。